某男，72岁。既患肾阳不足、膀胱虚寒之小便频数，又患寒郁气滞之疝痛。宜选用的药是
A. 陈皮
B. 川楝子
C. 香附
D. 甘松
E. 乌药

正确答案：E。乌药

解析：本题考查的是乌药的主治病证。某男，72岁。既患肾阳不足、膀胱虚寒之小便频数，又患寒郁气滞之疝痛。宜选用的药是乌药（E对）。乌药：【主治病证】（1）寒凝气滞之胸闷胁痛、脘腹胀痛、疝气疼痛及痛经。（2）肾阳不足、膀胱虚寒之小便频数、遗尿。陈皮（A错）：【主治病证】（1）脾胃气滞之脘腹胀满或疼痛、嗳气、恶心呕吐。（2）湿浊中阻之胸闷腹胀、纳呆便溏。（3）痰湿壅肺之咳嗽气喘。川楝子（B错）：【主治病证】（1）肝气郁滞或肝胃不和之胸胁、脘腹胀痛，疝气痛。（2）虫积腹痛。（3）头癣。香附（C错）：【主治病证】（1）肝气郁滞之胸胁、脘腹胀痛，疝气痛。（2）肝郁之月经不调、痛经、乳房胀痛。（3）脾胃气滞，脘腹胀痛。甘松（D错）：【主治病证】（1）思虑伤脾或寒郁气滞引起的胸闷、脘腹胀痛、不思饮食。（2）湿脚气。